不得在零售药店销售的是
A. 生化药品
B. 一类精神药品
C. 二类精神药品
D. 抗生素注射剂
E. 大输液

正确答案：B。一类精神药品

解析：本题考查方药与非处方药销售管理。不得在零售药店销售的是一类精神药品（B对）。药品零售企业不得经营的药品：麻醉药品、放射性药品、第一类精神药品、终止妊娠药品、蛋白同化制剂、肽类激素（胰岛素除外）、药品类易制毒化学品、疫苗、以及我国法律法规规定的其他药品零售企业不得经营的药品。生化药品（A错）、二类精神药品（C错）、抗生素注射剂（D错）、大输液（E错）可以在零售药店销售。